关于吸收系数（E1%1cm）的说法，正确的有
A. 通常用于红外分光光度法测定药物含量时的计算
B. 其物理意义为当溶液浓度为1%，液层厚度为1cm时吸光度数值
C. 符号中1%的单位为g/ml
D. 主要用于药物中杂质限量的计算
E. 系旋光度测定法中常用的物理常数

正确答案：B、E。其物理意义为当溶液浓度为1%，液层厚度为1cm时吸光度数值；系旋光度测定法中常用的物理常数

解析：本题考查吸收系数法。关于吸收系数（E1%1cm）的说法，正确的有其物理意义为当溶液浓度为1%，液层厚度为1cm时吸光度数值（B对）、系旋光度测定法中常用的物理常数（E对）。吸收系数是旋光度测定法中常用的物理常数，其物理意义为当溶液浓度为1%（1g/100ml）（C错）、液层厚度为1cm时，在一定条件（波长、溶剂、温度）下的吸光度。吸收系数通常用于紫外-可见分光光度法测定药物含量时的计算（A错），一般不用于杂质限量的计算（D错）。